下颌牙槽嵴承托（牙合）力的区域面积仅约为上颌的
A. 0.1
B. 0.2
C. 0.3
D. 0.4
E. 0.5

正确答案：E。0.5

解析：下颌牙槽嵴承托（牙合）力的区域面积仅约为上颌的50%，因此下颌牙槽嵴单位面积受力较大。掌握“牙列缺失后的病因及影响”知识点。